涩脉的主病是
A. 血瘀
B. 食滞
C. 痰饮
D. 热证
E. 湿证

正确答案：A。血瘀

解析：本题考查的是涩脉与主病。涩脉的主病是血瘀（A对）。涩脉与主病：［脉象］往来艰涩不畅，有如轻刀刮竹。［主病］气滞、血瘀、精伤、血少。食滞（B错）与痰饮（C错）为滑脉的主病。滑脉与主病：［脉象］“往来流利，如盘走珠”，指下有一种圆滑感。［主病］痰饮、食滞、实热等。平人脉滑而冲和，是营卫充实之象。妇人妊娠亦常见滑象，是血气充盛而和调的表现。热证（D错）为数脉的主病。数脉与主病：［脉象］一息脉来五至以上（相当于每分钟脉搏在90次以上），“去来促急”。［主病］主热证。有力为实热，无力为虚热。湿证（E错）为细脉的主病。细脉与主病：［脉象］脉来细小如线，软弱无力，但应指明显。［主病］气血两虚、诸虚劳损，又主湿病。